哪一项不是下颌下三角的结构
A. 舌神经
B. 下颌下腺导管
C. 下颌下淋巴结
D. 下颌下腺
E. 舌下腺

正确答案：E。舌下腺

解析：下颌下三角的内容：下颌下腺、下颌下淋巴结、面静脉、面动脉、舌神经、下颌下腺导管、舌下神经。掌握“颈部分区、颈筋膜层次及下颌下三角解剖特点”知识点。